女婴，10个月，发热咳嗽5天，烦躁呕吐2天，抽搐2次。查体，40℃，嗜睡，前卤隆起，呼吸急促，双肺闻及细湿啰音，颈无抵抗，双侧巴氏症阳性，脑脊液检查，外观浑浊，白细胞800×10⁹/L，N0.80，L0.20，蛋白质2g/L，糖1.2mmol/L，氯化物102mmol/L，涂片找菌阴性，PPD阴性。假设信息，患儿经治疗后好转，3日后再次发热，呕吐，惊厥发作，最可能出现的并发症是
A. 硬膜下积液
B. 脑脓肿
C. 抗利尿激素分泌异常综合征
D. 脑室管膜炎
E. 脑水肿

正确答案：A。硬膜下积液

解析：患儿最可能诊断的是化脓性脑膜炎，经化脓性脑膜炎有效治疗48～72小时后脑脊液有好转，但体温不退或体温下降后再升高；或一般症状好转后又出现意识障碍、惊厥、前囟隆起或颅压增高等症状，最可能出现的并发症是硬膜下积液，（A对）抗生素对并发脑脓肿（B错）有效，多无复发表现。并发脑积水（E错），患儿表现为烦躁不安、嗜睡、呕吐、惊厥发作，头颅进行性增大，颅缝分离，前囟扩大饱满、头颅破壶音和头皮静脉扩张。并发脑室管膜炎（D错）主要发生在治疗被延误的婴儿。抗利尿激素分泌异常综合征（C错）多无复发惊厥的表现。